男性，29岁。右下后牙进食时酸痛明显3个月余，无自发痛。口腔检查：右下6近中邻面龋洞，叩诊（-），探诊（+），无松动。拟直接牙体修复治疗，备洞时采用的基本固位形不包括
A. 侧壁固位
B. 倒凹固位
C. 鸠尾固位
D. 梯形固位
E. 盒状洞形固位

正确答案：E。盒状洞形固位

解析：本题考查固位形。男性，29岁。右下后牙进食时酸痛明显3个月余，无自发痛。口腔检查：右下6近中邻面龋洞，叩诊（-），探诊（+），无松动。拟直接牙体修复治疗，备洞时采用的基本固位形不包括盒状洞形固位（E错，为本题的正确答案）。盒状洞型是窝洞最基本的抗力形。固位形是防止充填体在侧向或垂直方向力量作用下移位、脱落的形状，窝洞的基本固位形结构包括：侧壁固位（A对）、倒凹固位（B对）、鸠尾固位（C对）、梯形固位（D对）。